男，45岁。体检发现“转氨酶”升高。既往体健，吸烟史25年，约20支/日，饮酒史15年，每日饮高度白酒6两。查体：BP125/75mmHg，身高170cm，体重65kg。实验室检查：ALT68U/L，AST200U/L。肝炎病毒标志物阴性，自身免疫抗体阴性。腹部B超示肝脏轻度增大，回声增强，后部衰减。最基本的治疗措施是
A. 戒酒
B. 控制饮食和加强体育锻炼
C. 应用保肝药物
D. 休息并减少体力活动
E. 应用调脂药物

正确答案：A。戒酒

解析：男性患者，长期吸烟史、饮酒史，转氨酶升高，AST升高比ALT升高明显，AST/ALT大于2，腹部B超示肝脏轻度增大，回声增强，后部衰减（脂肪肝的典型特征）。因此考虑诊断酒精性脂肪肝。最基本的治疗措施是戒酒（A对）。戒酒能显著改善各个阶段病人的组织学改变和生存率，并可减轻门静脉压力及减缓向肝硬化发展的进程。因此，对酒精性肝病病人，应劝其及早戒酒。